以下哪项不是乳牙龋齿药物治疗中的药物
A. 2%氟化钠
B. 8%氟化亚锡
C. 12.3%酸性氟磷酸钠溶液
D. 10%氨硝酸银溶液
E. 38%氟化氨银溶液

正确答案：C。12.3%酸性氟磷酸钠溶液

解析：乳牙龋齿药物治疗时的常用药物为2%氟化钠，8%氟化亚锡，1.23%酸性氟磷酸钠溶液，10%氨硝酸银，38%氟化氨银，氟保护漆和75%氟化钠甘油糊剂等溶液。掌握“乳牙龋”知识点。